女，36岁。结婚8年未孕。月经规律，周期22天，经期5～6天，无痛经。基础体温为双相型，高温相为8天。月经来潮后6小时子宫内膜活检，病理检查结果最可能是
A. 萎缩型子宫内膜
B. 分泌期子宫内膜腺体分泌不良
C. 分泌期与增殖期内膜并存
D. 子宫内膜单纯性增生
E. 增殖期子宫内膜

正确答案：B。分泌期子宫内膜腺体分泌不良

解析：女性无避孕性生活至少12个月而未孕称为不孕症。患者女，36岁。月经规律，周期22天（虽在正常范围内，但卵泡期延长、黄体期缩短，以致患者不易受孕或在妊娠早期流产），经期5～6天，无痛经。基础体温为双相型（有排卵），高温相为8天（体温升高日数≤11日，提示黄体功能不足），为黄体功能异常型功血，子宫内膜分泌反应不良。综合患者病史、症状、查体，最可能的诊断是分泌期子宫内膜腺体分泌不良（B对）。分泌期与增殖期内膜并存（P351）(C错）表现为月经周期正常，但经期延长，长达9-10日，且出血量多。子宫内膜单纯性增生（P345）（D错）为子宫内膜增生症，其与增殖期子宫内膜（E错）、萎缩型子宫内膜（A错）均属于无排卵性功能失调性子宫出血，其最常见临床表现为月经周期紊乱，经期长短不一，经期不定或增多，甚至大量出血。